下列有关类固醇激素合成的组织中除了某组织外，其他都是正确的
A. 肺
B. 肾上腺皮质
C. 睾丸
D. 卵巢
E. 肾

正确答案：A。肺